1g脂肪产生的能量为
A. 8.77kcal（36.7kJ）
B. 4kcal（16.7kJ）
C. 6kcal（25.12kJ）
D. 9kcal（37.6kJ）
E. 3kcal（12.56kJ）

正确答案：D。9kcal（37.6kJ）